青春期分期的年龄范围是
A. 10～20岁
B. 9～15岁
C. 13～20岁
D. 12～15岁
E. 12～18岁

正确答案：A。10～20岁

解析：本题考查青春期的年龄范围。青春期是指人体生长发育成熟前一个迅速发育的阶段，是儿童到成人的过渡期，年龄范围一般是10～20岁（A对BCDE错）。